1982年某市为了调查老年人多发病的分布情况，对该市7个区的9个不同地段抽取60岁及以上的老年6393例进行调查。这属于
A. 普查
B. 抽样调查
C. 队列研究
D. 筛检
E. 发病率调查

正确答案：B。抽样调查

解析：本题考查抽样调查的概念。抽样调查（B对ACDE错）是通过对样本中的研究对象的调查研究来推论其所在总体的情况的一种研究方法。通过调查某地老人的发病情况，可采用抽样调查的方法用样本来估计总体的情况。